分布于手掌外侧2/3皮肤的是
A. 正中神经
B. 尺神经
C. 正中神经和尺神经
D. 正中神经和桡神经
E. 面神经

正确答案：A。正中神经

解析：正中神经（A对）的感觉纤维分布于桡侧半手掌、桡侧三个半手指掌面皮肤及其中节和远节指背皮肤。尺神经（B错）的浅支分布于小鱼际表面的皮肤、小指掌面皮肤和环指尺侧半掌面皮肤。桡神经（D错）的浅支分布于手背桡侧半皮肤和桡侧两个半手指近节背面的皮肤。面神经（E错）主要传导耳部小块皮肤的浅感觉和面肌的本体感觉。